久病面色苍白，却时而泛红如妆，游移不定者，其证候是
A. 阴虚证
B. 实热证
C. 气虚证
D. 戴阳证
E. 失血证

正确答案：D。戴阳证

解析：久病面色苍白，却时而泛红如妆，游移不定者，属戴阳证，是因久病肾阳虚衰，阴寒内盛，阴盛格阳，虚阳上越所致，属病重（D对）。午后两颧潮红者，属阴虚证（A错）。满面通红者，属实热证（B错）。面色发白主虚证（包括血虚、气虚、阳虚）、寒证、失血（CE错）。